男，28岁，查血压21.3/12.6kPa（160/95mmHg），Hb80g/L，尿蛋白+，颗粒管型2～3个/HP，BUN10mmol/L，Cr220μmol/L。对该患者不宜采取
A. 低蛋白饮食
B. 高蛋白饮食
C. 低钠饮食
D. 根据尿量多少适当限水
E. 低磷饮食

正确答案：B。高蛋白饮食

解析：青年男性患者，血压160/95mmHg（正常为90～130/60～90mmHg，提示有高血压）。Hb80g/L（正常为120～160g/L，＜30g/L为极重度贫血）。尿蛋白+（正常为阴性，提示有蛋白尿）、颗粒管型2～3个/HP（正常为阴性，提示有管型尿）、BUN10mmol/L（血尿素氮正常为3.2～7.1mmol/L，提示有氮质血症）、Cr220μmol/L（血肌酐正常值为88.4～176.8μmol/L，提示血肌酐升高）。综合患者的临床表现、实验室检查，考虑诊断为肾功能衰竭。肾功能衰竭患者，应当限制蛋白质摄入，一般采用低蛋白饮食（B错，为本题正确答案）（A对），以减少含氮代谢产物的生成，减轻氮质血症。肾功能衰竭还可因肾脏排泄功能降低，导致水钠潴留、磷排泄障碍，引起水肿和高磷血症，因此，应低钠饮食（C对）、根据尿量多少适当限水（D对）、低磷饮食（E对）。